治疗便溏尤应慎用的药物是
A. 石膏
B. 芦根
C. 知母
D. 天花粉
E. 淡竹叶

正确答案：C。知母

解析：知母性寒质润，有滑肠作用，故脾虚便溏者慎用（C对）。石膏（A错）性味辛甘大寒，脾胃虚寒及阴虚内热者忌用。芦根（B错）性味甘寒，脾胃虚寒者慎用。天花粉（D错）甘微苦微寒，孕妇慎用，不宜与川乌、草乌、附子同用。淡竹叶（E错）性味甘、淡，寒，脾胃虚弱者用量宜少。